某研究者为探讨脂肪摄入量与男性前列腺癌的关系，在社区内选择高脂肪和低脂肪摄入者各200名，从50岁开始对他们进行随访10年。在随访期间，高脂肪摄入组中有20人，低脂肪摄入者中有10人被诊断为前列腺癌，这种研究方法为
A. 现况调查
B. 实验研究
C. 生态学研究
D. 队列研究
E. 病例对照研究

正确答案：D。队列研究

解析：题中表述的研究方法为队列研究（D对）。队列研究是根据有无暴露某因素或暴露程度分组的研究方式，用来判定暴露因素与结局之间有无因果关联及关联大小的一种观察性研究方法。该题题干根据暴露因素程度（即脂肪摄入量的高低）将研究对象分成了两组，追踪各组的结局并比较其差异。是比较典型的队列研究（D对）。现况调查（A错）（P047）是普查或抽样调查的方法收集一定的数据，并对数据分布特征加以描述的研究方式。实验研究（B错）又称为流行病学试验，通过对比实验组和对照组的差别，从而判断实验因素的效果。生态学研究（C错）是在群体的水平上研究某种因素与疾病之间的关系，以群体为观察和分析的单位，通过描述不同人群中某因素的暴露状况与疾病的频率，分析该暴露因素与疾病之间的关系。病例对照研究（E错）（P059）则是根据是否患有某种待研究的疾病来分组的。